患者，男，35岁。患再生障碍性贫血3年，面色无华，头晕，气短，乏力，动则加剧，舌淡，苔薄白，脉细弱。治疗应首先考虑的方剂是
A. 右归丸合当归补血汤
B. 左归丸右归丸合当归补血汤
C. 八珍汤
D. 六味地黄丸合桃红四物汤
E. 左归丸合当归补血汤

正确答案：C。八珍汤

解析：患者为中年男性，再生障碍性贫血3年，出现面色无华，头晕，气短，乏力，动则加剧，为典型的气血不足的表现，又根据患者的舌苔脉象，可判断患者属于再生障碍性贫血中医证型的气血两虚证，治宜补益气血，故首先应考虑的方剂为八珍汤（C对）。